下列糊剂类根管充填材料中充填根管效果最好的是
A. 氢氧化钙
B. 三锌糊剂
C. 三聚甲醛糊剂
D. 氧化锌丁香油酚黏固剂
E. 氯仿牙胶

正确答案：A。氢氧化钙

解析：本题考查糊剂类根管充填材料。氢氧化钙呈强碱性，可中和酸性炎症渗出，具有较强的抗菌作用，促进根尖孔钙化，还可促进根尖周骨缺损愈合，因此是糊剂类根管充填材料中充填根管效果最好的（A对）。氧化锌丁香油酚黏固剂对根尖周组织有轻度的致炎性，可产生轻微炎症，导致疼痛、愈合迟缓等（D错）。三聚甲醛糊剂属于牙髓失活剂，不属于根管充填剂（C错）。氯仿牙胶不属于糊剂类根管充填材料（E错）。